在维生素C注射液中作为溶剂的是
A. 依地酸二钠
B. 碳酸氢钠
C. 亚硫酸氢钠
D. 注射用水
E. 甘油

正确答案：D。注射用水

解析：本题考查维生素C注射液的处方分析。维生素C注射液的处方分析：维生素C-主药；依地酸二钠（A错）-金属螯合剂；碳酸氢钠（B错）-pH调节剂；亚硫酸氢钠（C错）-抗氧剂；注射用水（D对）-溶剂。此处方中无甘油（E错）。